在骨骼肌兴奋-收缩偶联中起关键作用的离子是
A. Na⁺
B. K⁺
C. Ca²⁺
D. Mg²⁺
E. Cl⁻

正确答案：C。Ca²⁺

解析：细胞内Ca²⁺的释放，将骨骼肌产生动作电位的电兴奋过程与肌丝滑行的机械收缩联系起来，骨骼肌兴奋-收缩耦联的偶联因子是Ca²⁺（C对）。